对临床疑诊自发性气胸患者，应首选的检查方法是
A. B型超声波
B. 胸部CT
C. 胸部X线
D. 磁共振成像
E. 纤维支气管镜

正确答案：C。胸部X线

解析：胸部X线（C对）检查操作简便，用时较少，且能发现胸部的大多数病变，故对临床疑诊自发性气胸患者，应首选的检查方法是胸部X线。自发性气胸的X线表现为：①无肺纹理的透亮影；②可见被压缩的肺的边缘；③肺组织向肺门方向压缩。B型超声波（A错）一般用于腹部实质性脏器病变的检查，一般不用于检查胸部病变。胸部CT（B错）、磁共振成像（D错）价格昂贵，操作复杂，一般不用于自发性气胸急诊检查。纤维支气管镜（E错）主要用于检查支气管病变，对诊断自发性气胸意义不大。